男性，8岁。发热，胸痛，气短一周余，查体：右胸部饱满，叩诊呈浊音，右胸呼吸音减弱，实验室检查：白细胞20×10⁹/L，中性粒细胞分数90%，胸透示：右胸腔积液。首选诊断方法
A. 胸腔穿刺
B. 胸部CT
C. 纤维支气管镜
D. MRI
E. 普通X线

正确答案：A。胸腔穿刺

解析：患者发热，胸痛，气短，右侧胸腔积液，白细胞20×10⁹/L（正常4～10×10⁹/L），中性粒细胞分数90%（正常为50%～70%），提示有感染，根据其临床表现和辅助检查，应首先考虑是由肺部炎症导致的胸腔积液。诊断性胸腔穿刺（A对）和胸水检查对明确积液性质及病因诊断均至关重要，大多数积液的原因通过胸水检查可确定，应作为首选。胸部CT（B错）、MRI（D错）、普通X线（E错）为重要的影像学检查，对明确病灶位置特点有重要意义，但不能作为确诊依据。纤维支气管镜（C错）适用于做肺叶、段及亚段支气管病变的观察，活检采样，对诊断中央型肺癌有重要意义。